痄腮的病变经络是
A. 少阳经、厥阴经
B. 少阳经、阳明经
C. 少阳经、太阳经
D. 少阴经、厥阴经
E. 太阳经、阳明经

正确答案：A。少阳经、厥阴经

解析：本题考查痄腮的病机。本病多因外感风热疫毒从口鼻而入，遏阻少阳经脉，郁而不散，蕴结于耳下腮部所致。少阳与厥阴相表里，足厥阴肝经过阴器，若受邪较重，邪从少阳胆经内传厥阴肝经。（A对）（BCDE错）